均具有疏散风热升阳举陷功效的药物是
A. 桑叶、菊花
B. 薄荷、牛蒡子
C. 升麻、牛蒡子
D. 蝉蜕、牛蒡子
E. 升麻、柴胡

正确答案：E。升麻、柴胡

解析：柴胡的功效为疏散退热，疏肝解郁，升举阳气。升麻的功效为发表透疹，清热解毒，升举阳气（E对）。桑叶的功效为疏散风热，清肺润燥，平抑肝阳，清肝明目。菊花的功效为疏散风热，平抑肝阳，清肝明目，清热解毒（A错）。薄荷的功效为疏散风热，清利头目，利咽，透疹，疏肝行气（B错）。牛蒡子的功效为疏散风热，宣肺祛痰，利咽透疹，解毒消肿。升麻的功效为发表透疹，清热解毒，升举阳气（C错）。蝉蜕的功效为疏散风热，利咽开音，透疹，明目退翳，息风止痉（D错）。